牙骨质龋临床上多见于
A. 乳前牙
B. 乳磨牙
C. 年轻恒牙根龋
D. 老年人冠龋
E. 老年人根龋

正确答案：E。老年人根龋

解析：本题考查牙骨质龋。牙骨质龋临床上多见于老年人根龋（E对）。牙骨质龋多发生于牙龈萎缩、牙根面暴露后，牙骨质表面菌斑沉积，继而龋病形成，临床上多见于老年人根龋。